以下关于颞下颌关节盘的叙述正确的是
A. 有吸收震荡的作用
B. 缓解关节内压
C. 有较好的形态可塑性
D. 维持关节运动的稳定
E. 以上都正确

正确答案：E。以上都正确

解析：颞下颌关节盘具有吸收震荡、缓解关节内压的作用；具有较好的形态可塑性，对于调节关节面和髁突之间形态、大小的不均衡，进而维持关节运动等功能的稳定，起着重要作用。掌握“颞下颌关节的解剖特点”知识点。